平滑面龋表层孔隙所占容积
A. 0.01
B. 0.05
C. 2～4%
D. 5%～25%
E. 10%～30%

正确答案：B。0.05

解析：表层：在龋损区表面有一较为完整的表层，而且较之深层呈放射线阻射，孔隙容积约占釉质体积5%。掌握“牙釉质龋”知识点。